下面哪种疫苗是减毒活疫苗
A. 卡介苗
B. 乙脑灭活疫苗
C. 百日咳菌液
D. 白喉类毒素
E. 破伤风类毒素

正确答案：A。卡介苗

解析：本题考查疫苗的分类。卡介苗（A对）系用人工减毒的牛型结核分枝杆菌制成的活疫苗，无致病力，保留产生免疫力的抗原性，为冻干剂型。乙脑灭活疫苗（B错）、百日咳菌液（C错）属于灭活疫苗。白喉类毒素（D错）、破伤风类毒素（E错）属于类毒素，既不属于活疫苗，也不属于灭活疫苗。